RNA是
A. 脱氧核糖核苷
B. 脱氧核糖核酸
C. 核糖核酸
D. 脱氧核糖核苷酸
E. 核糖核苷酸

正确答案：C。核糖核酸

解析：核糖核酸：由至少几十个核糖核苷酸通过磷酸二酯键连接而成的一类核酸，因含核糖而得名，简称RNA。掌握“核苷酸”知识点。